发病率与患病率有相同之处，又有差异，因而常易混淆，下列哪种说法不正确
A. 两者均为测量疾病频率的指标
B. 计算患病率时，其分子应为某特定时期或特定时点内患有某病的所有患者
C. 计算患病率时，其分子不应包括在研究期间或时点之前已经发病的病例
D. 发病率是指在特定时间内某人群中某病新病例的发生频率
E. 计算发病率和患病率时，选择公倍数K值的原则相同

正确答案：C。计算患病率时，其分子不应包括在研究期间或时点之前已经发病的病例